下面关于胃的描述，正确的是
A. 入口为幽门
B. 胃小弯凸向左上方
C. 胃大弯凹向左下方
D. 角切迹为胃体与幽门部的分界处
E. 胃大部分位于腹上区

正确答案：D。角切迹为胃体与幽门部的分界处

解析：胃的入口为贲门(A错)，胃小弯凹向右上方(B错)，胃大弯凸向左下方(C错)，角切迹为胃体的下界，而胃体下界与幽门之间的部分为幽门部，故角切迹为胃体和幽门部的分界(D对)，胃在中等充盈时一般大部分位于左季肋区，小部分位于腹上区(E错)。